以下哪种细胞不是自律细胞
A. 窦房结P细胞
B. 心房、心室肌细胞
C. 心室传导束的浦肯野细胞
D. 房结区细胞
E. 结希区细胞

正确答案：B。心房、心室肌细胞